异种移植时发生超急性排斥反应的机制是
A. 移植物供血不足
B. 受者体内有抗供者组织抗原的抗体
C. MHC不相配
D. 受者免疫功能紊乱
E. 受者体内有自身反应性T细胞

正确答案：B。受者体内有抗供者组织抗原的抗体